小活络丸的功能有
A. 发表散寒
B. 祛风散寒
C. 化痰除湿
D. 活血止痛
E. 缓急止痛

正确答案：B、C、D。祛风散寒；化痰除湿；活血止痛

解析：本题考查的是小活络丸的功能。小活络丸的功能有祛风散寒（B对）、化痰除湿（C对）与活血止痛（D对）。小活络丸：【功能】祛风散寒，化痰除湿，活血止痛。紫苏：【功效】发表散寒（A错），行气宽中，安胎，解鱼蟹毒。小建中合剂：【功能】温中补虚，缓急止痛（E错）。